列入现行麻醉药品品种目录的是
A. 麦角胺
B. 地芬诺酯
C. 氯胺酮
D. 麦角胺咖啡因片
E. 复方甘草片

正确答案：B。地芬诺酯

解析：本题考查麻醉药品品种。列入现行麻醉药品品种目录的药品包括：吗啡、芬太尼、布桂嗪、地芬诺酯（B对）等。